处方中外文缩写OU.代表
A. 双眼
B. 左耳
C. 左眼
D. 右耳
E. 右眼

正确答案：A。双眼

解析：本题考查处方中常见的外文缩写及其含义。医师在书写处方正文时会采用拉丁文缩写或者英文缩写表示，其中双眼（A对）的英文缩写是OU.。右眼（E错）的英文缩写是OD.。左眼（C错）的英文缩写是OS.。左耳（B错）、右耳（D错）的外文缩写在最新版考试指南中未明确说明。